关于乳牙的早萌牙与“上皮珠”的鉴别，下列说法正确的是
A. 上皮珠与早萌牙一样，都有牙齿的基本结构
B. 上皮珠是牙板残余所形成，而牙板残余也可以分化形成早萌牙
C. 上皮珠与早萌牙一样，均可自动脱落
D. 上皮珠有牙槽骨支持，而早萌牙无牙槽骨支持
E. 上皮珠与早萌牙一样，均有牙冠形态，但上皮珠为灰白色

正确答案：C。上皮珠与早萌牙一样，均可自动脱落

解析：本题考查乳牙滞留和乳牙早萌。早萌的乳牙牙冠形态基本正常，但是釉质、牙本质菲薄，且矿化不良，牙根尚未发育或牙根发育很少，只有黏骨膜联结而无牙槽骨支持，极度松动，可自行脱落吸入呼吸道出现危险。上皮珠是新生儿牙槽嵴黏膜上出现的角质珠，是类似牙齿的灰白色的球状物，米粒大小，数量不等。上皮珠是牙板残余所形成的角化物，并非真正的牙齿，一般不需治疗，生后数周可自行脱落（C对）。